下述何种药物属于周期特异性抗肿瘤药
A. 顺铂
B. 马利兰
C. 丝裂霉素
D. 阿糖胞苷
E. 环磷酰胺

正确答案：D。阿糖胞苷